为硫化物类矿物辰砂族辰砂，主含HgS的是
A. 石膏
B. 雄黄
C. 赭石
D. 自然铜
E. 朱砂

正确答案：E。朱砂

解析：本题考查的是朱砂药材的来源。为硫化物类矿物辰砂族辰砂，主含HgS的是朱砂（E对）。朱砂：【来源】为硫化物类矿物辰砂族辰砂。主含硫化汞（HgS）。石膏（A错）：【来源】为硫酸盐类矿物硬石膏族石膏。主含含水硫酸钙（CaSO₄·2H₂O）。雄黄（B错）：【来源】为硫化物类矿物雄黄族雄黄。主含二硫化二砷（As₂S₂）。赭石（C错）：【来源】为氧化物类矿物刚玉族赤铁矿。主含三氧化二铁（Fe₂O₃）。自然铜（D错）：【来源】为硫化物类矿物黄铁矿族黄铁矿。主含二硫化铁（FeS₂）。